关于哺乳期避孕，正确的是
A. 不需要避孕
B. 应采用避孕药物
C. 最好使用工具避孕
D. 使用填埋避孕剂型
E. 剖宫产术3个月放置IUD

正确答案：C。最好使用工具避孕

解析：哺乳产妇常月经复潮延迟，平均在产后4～6个月恢复排卵，首次月经来潮前多有排卵，有受孕可能，故若已恢复性生活，应采取避孕措施（A错）。哺乳期避孕的原则是不影响乳汁质量和婴儿健康。哺乳者以工具避孕为宜（C对），不哺乳者可选用药物避孕（BD错）。IUD（宫内节育器）应在剖宫产后半年放置（E错）。